高危滋养细胞肿瘤患者首选的化疗方案是
A. PVB
B. TP
C. BEP
D. EMA-CO
E. EP-EMA

正确答案：D。EMA-CO

解析：高危滋养细胞肿瘤患者首选的化疗方案是EMA-CO方案（D对）。PVB，TP，BEP，EP-EMA方案用于耐药复发病例的治疗（ABCE错）。